一氧化碳中毒患者其皮肤和黏膜可呈
A. 暗红色
B. 鲜红色
C. 青紫色
D. 樱桃红色
E. 苍白色

正确答案：D。樱桃红色

解析：本题考查一氧化碳中毒皮肤和黏膜体征。CO中毒病人皮肤黏膜在中毒之初呈现樱桃红色（D对ABCE错）是因为HbCO是鲜红色的。一氧化碳中毒时的樱桃红色的皮肤和黏膜与其他缺氧时的症状不同，是其临床特点之一。